女，18岁。近几个月来常因琐事与父母发生激烈争吵，闷闷不乐，被诊断为抑郁症而入院治疗。两周后，其父母去探视，患者起初表现出既想见又不想见的矛盾心理，但最终还是决定拒绝见其父母。医生根据病情同意了患者的决定。根据《精神卫生法》，医生可以限制患者父母会见患者的理由是
A. 医疗机构尚未作出再次诊断结论
B. 未取得医疗机构负责人同意
C. 为了避免妨碍治疗
D. 患者父母要求见面的理由不充分
E. 未取得当地卫生计生行政部门批准

正确答案：C。为了避免妨碍治疗

解析：该患者近几个月来常因琐事与父母发生激烈争吵，诊断为抑郁症而入院治疗，其父母去探视，患者拒绝见其父母。根据《精神卫生法》规定，为了避免妨碍治疗（C对）可以暂时性限制患者的通讯和会见探访者等权利，限制患者父母会见患者。